对于甲状腺功能亢进病人，以下哪项是拔牙的禁忌症
A. 脉搏在80次/分以下
B. 血糖控制在7.8mmol/L以下
C. 基础代谢率控制在+20%以上
D. 血压为160/80mmHg
E. 所拔之牙无牙周根尖等急性炎症

正确答案：C。基础代谢率控制在+20%以上

解析：本题考查系统疾病对牙拔除术的影响及拔牙禁忌证-甲状腺功能亢进。对于甲状腺功能亢进病人，基础代谢率控制在+20%以上（C错，为本题的正确答案）是拔牙的禁忌症。甲状腺功能亢进的患者进行拔牙应在本病控制后，静息脉搏在100次/min以下（A对），基础代谢率控制在+20%以下方可进行。拔牙时空腹血糖以控制在8.88mmol/L以下为宜，未控制而严重的糖尿病，应暂缓拔牙，因此血糖控制在7.8mmol/L以下（B对）可以施行拔牙术。若血压高于180/100mmHg则应先控制后再行拔牙，160/80mmHg是低于这个数值的，故血压为160/80mmHg（D对）可以进行拔牙。感染急性期是拔牙的禁忌症，若所拔之牙无牙周根尖等急性炎症（E对）则为拔牙的适应症，可进行拔牙。